（牙合）关系检查的内容
A. 上下颌牙列中线是否一致
B. 上下第一磨牙是否是中性（牙合）关系
C. 息止颌位的检查
D. （牙合）干扰检查
E. 以上都对

正确答案：E。以上都对

解析：（牙合）关系检查：①正中位的检查：上下牙列是否有广泛均匀的接触关系；上下颌牙列中线是否一致；上下第一磨牙是否是中性关系；前牙覆（牙合）、覆盖是否在正常范围之内；左右侧平面是否匀称；②息止颌位的检查比较息止颌位与正中（牙合）位时，下牙列中线有否变化；颌间隙的大小有无异常；③（牙合）干扰检查仔细检查：正中咬合和前伸、侧向咬合移动时；有无牙尖干扰。掌握“修复学临床检查”知识点。